高血压合并糖尿病患者，不宜用下列哪类药物
A. 二氮嗪、氢氯噻嗪
B. 血管紧张素转换酶抑制剂
C. 美托洛尔
D. 哌唑嗪
E. 以上均不能用

正确答案：C。美托洛尔

解析：高血压合并糖尿病患者，由于β受体拮抗剂（C错，为本题正确答案）可增加胰岛素抵抗，还可能掩盖和延长低血糖反应，使用时应加注意。二氮嗪、氢氯噻嗪（A对）为利尿剂，可通过排钠、排水，降低外周阻力而降压，适用于轻中度高血压，对单纯收缩期高血压、盐敏感性高血压、合并肥胖或糖尿病高血压、更年期女性、合并心力衰竭和老年高血压有较强降压效果；血管紧张素转换酶抑制剂（B对）具有改善胰岛素抵抗和减少尿蛋白作用，对肥胖、糖尿病和心脏、肾脏靶器官受损的高血压患者具有较好效果；哌唑嗪（D对）为α受体拮抗剂，曾多年用于临床并有一定降压疗效，但因副作用较多，目前不主张单独使用，但可用于复方制剂或联合治疗。